急性苯中毒主要临床表现为
A. 神经系统
B. 循环系统
C. 血液系统
D. 消化系统
E. 泌尿系统

正确答案：A。神经系统